患者，男，70岁。腹胀，腹痛，恶心，呕吐，无排便、排气2天；查体：腹胀不均匀，以左下腹明显，可见肠型，左下腹有明显压痛，应首先考虑的诊断是
A. 肠套叠
B. 粘连性肠梗阻
C. 嵌顿疝
D. 麻痹性肠梗阻
E. 肠扭转

正确答案：E。肠扭转

解析：患者腹胀，腹痛，无排便排气，腹胀不均匀，以左下腹明显，可见肠型，左下腹有明显压痛，应首先考虑的诊断是肠扭转，因为肠襻及其系膜过长，肠扭转后肠腔受压而变窄，引起梗阻、扭转与压迫影响肠管的血液供应（E对）。肠套叠典型表现腹痛、呕吐、便血及腹部包块（A错）。粘连性肠梗阻当肠内容物通过受阻时，则可产生腹胀、腹痛、恶心呕吐及排便障碍等一系列症状（B错）。嵌顿疝是指患腹股沟斜疝的病人，当腹内压突然升高时，疝内容物可强行扩张疝囊颈而突入疝囊，随后因疝囊颈弹性收缩，将疝内容物卡住而不能回纳腹腔的情况（C错）。麻痹性肠梗阻患者腹胀显著，无阵发性绞痛等，肠蠕动减弱或消失，罕有引起肠穿孔者（D错）。